以下哪种资料属于分类资料的统计描述
A. 变异系数
B. 构成比
C. 极差
D. 标准差
E. 中位数

正确答案：B。构成比

解析：率、构成比、相对比等资料属于常用相对数，常用相对数属于分类资料的统计描述。掌握“分类资料的统计描述与推断”知识点。